临床医生治疗肺虚燥咳，脾胃虚弱，肾虚精亏，宜使用的饮片是
A. 熟地黄
B. 生地黄
C. 制何首乌
D. 阿胶珠
E. 酒黄精

正确答案：E。酒黄精

解析：本题考查的是黄精的炮制作用。临床医生治疗肺虚燥咳，脾胃虚弱，肾虚精亏，宜使用的饮片是酒黄精（E对）。黄精：【炮制作用】黄精味甘，平。归脾、肺、肾经。具有补气养阴、健脾、润肺、益肾的功能。生黄精具麻味，刺激咽喉。蒸后补脾润肺益肾功能增强，并可除去麻味，以免刺激咽喉。用于肺虚燥咳，脾胃虚弱，肾虚精亏。酒黄精能助其药势，使之滋而不腻，更好地发挥补益作用。熟地黄（A错）：性味甘，微温。归肝、肾经。具有补血滋阴，益精填髓的功能。用于血虚萎黄，心悸怔忡，月经不调，崩漏下血，肝肾阴虚，腰膝酸软，骨蒸潮热，盗汗遗精，内热消渴，眩晕，耳鸣，须发早白。生地黄（B错）：性味甘，寒。归心、肝、肾经。为清热凉血之品，具有清热凉血、养阴生津的功能。用于热入营血，温毒发斑，吐血衄血，热病伤阴，舌绛烦渴，津伤便秘，阴虚发热，骨蒸劳热，内热消渴。制何首乌（C错）：味转甘厚而性转温，增强了补肝肾、益精血、乌须发、强筋骨的作用，用于血虚萎黄，眩晕耳鸣，须发早白，腰膝酸软，肢体麻木，崩漏带下，久疟体虚，高脂血症。同时消除了生何首乌滑肠致泻的副作用，使慢性病患者长期服用而不造成腹泻。阿胶珠（D错）：阿胶珠为蛤粉炒阿胶。蛤粉炒阿胶降低了滋腻之性，长于益肺润燥，质变酥脆，利于粉碎，同时也矫正了不良气味。用于阴虚咳嗽，久咳少痰或痰中带血。